通过个案调查可实现的研究目的是
A. 为了早发现、早诊断、早治疗宫颈癌
B. 对个别发生的麻疹患者进行调查
C. 烟草消耗量与肺癌的关系研究
D. 对临床诊疗过程中遇见的某罕见疾病病例的临床表现、治疗与转归等进行描述
E. 为了获取某地高校学生的乙肝感染率

正确答案：B。对个别发生的麻疹患者进行调查

解析：本题考查个案研究的目的。个案研究是指到发病现场对新发病例的接触史、家属及周围人群的发病或健康状况以及可能与发病有关的环境因素进行调查，以达到查明所研究病例的发病原因和条件，控制疫情扩散及消灭疫源地，防止再发生类似疾病的目的。其研究对象一般为传染病病人，如可对个别发生的麻疹患者进行调查（B对ACDE错）。